患者痰壅气逆，咳嗽喘逆，痰多胸闷，食少难消，舌苔白腻，脉滑。治疗宜选用
A. 山楂
B. 莱菔子
C. 神曲
D. 鸡内金
E. 麦芽

正确答案：B。莱菔子

解析：该题考查莱菔子的临床应用。患者痰壅气逆，咳嗽喘逆，痰多胸闷，治以降气化痰，止咳平喘，食少难消，舌苔白腻，脉滑，治以消食化积。莱菔子具有消食除胀，降气化痰的功效，尤善行气消胀（B对）。山楂具有消食化积，行气散瘀的功效，没有降气化痰的功能（A错）。神曲具有消食和胃的功效，没有降气化痰的功能（C错）。鸡内金具有消食健胃，涩精止遗的功效，消食化积作用较强，没有降气化痰的功能（D错）。麦芽具有消食健胃，回乳消胀的功效，主要用于米面薯芋食滞，没有降气化痰的功能（E错）。